与桡神经伴行的动脉是
A. 尺侧上副动脉
B. 肱深动脉
C. 尺侧下副动脉
D. 桡动脉
E. 尺动脉

正确答案：B。肱深动脉

解析：肱深动脉（B对）与桡神经伴行，其分支营养肱二头肌和肱骨，其终支参与肘关节网的组成。